患儿，2岁半。病初2天有轻微咳嗽，随后出现高热，体温达40℃，烦躁，频繁呕吐。查体：神志清楚，颈项强直；脑膜刺激征阳性，巴彬斯基征阳性；舌质红，苔薄黄；脑脊液检查：外观混浊，压力增高，细胞计数2000×10⁹/L；以多核细胞为主，糖0.8mmol/L，蛋白质1.1g/L。应首先考虑的诊断是
A. 病毒性脑膜脑炎
B. Reye综合征
C. 急性化脓性脑膜炎
D. 结核性脑膜炎
E. 隐球菌性脑膜炎

正确答案：C。急性化脓性脑膜炎

解析：根据患儿高热、烦躁、呕吐，查体：脑膜刺激征阳性，故定位于神经系统疾病，初步考虑脑膜炎，结合脑脊液检查，故应首先考虑化脓性脑膜炎（C对）——小儿化脓性脑膜炎，是小儿时期较为常见的由多种化脓菌引起的以脑膜炎症为主的中枢神经系统感染性疾病，临床主要以发热、头痛、呕吐、惊厥、意识障碍、颅内压增高、脑膜刺激征阳性及脑脊液脓性改变。典型化脑的脑脊液外观混浊，压力增高，白细胞总数显著增多，达1000×10⁶/L，分类以中性粒细胞为主，糖含量明显降低，常<1.1mmol/L，蛋白质含量增高，多>1g/L。病毒性脑膜脑炎（A错）临床表现与化脑相似，全身感染中毒及神经系统症状不重，脑脊液外观清亮，白细胞数0～数百×10⁶/L，以淋巴细胞为主，糖含量正常，细菌学检查阴性，脑脊液中病毒特异性抗体和病毒分离有助诊断。Reye综合征（B错）临床主要表现为发热、昏迷、惊厥等急性脑病表现，脑脊液无明显异常，伴有肝功能异常，部分患者血糖下降。结核性脑膜炎（D错）除婴儿外，一般起病较缓，常有结核接触史及其他部位结核病灶。PPD检查阳性有重要参考价值。脑脊液外观呈毛玻璃状，白细胞数<500×10⁶/L，以淋巴细胞为主，涂片抗酸染色和结核菌培养可帮助确定诊断。隐球菌性脑膜炎（E错）临床表现与化脓系脑膜炎相似，脑脊液压力增高，外观微混，毛玻璃样，蛋白含量轻～中度升高，细胞数增多，多在100×10⁶/L左右，以淋巴细胞为主，氯化物及葡萄糖多降低，脑脊液涂片墨汁染色可直接发现隐球菌。